大量出汗时尿量减少，主要原因是
A. 血浆胶体渗透压升高，导致肾小球过滤减少
B. 血浆晶体渗透压升高，引起ADH分泌增多
C. 肾素-血管紧张素系统活动增强，可引起醛固酮分泌增多
D. 交感神经兴奋，引起肾小球滤过减少
E. 血容量减少，导致肾小球滤过减小

正确答案：B。血浆晶体渗透压升高，引起ADH分泌增多

解析：大量出汗可引起机体失水多于溶质丧失，使血浆晶体渗透压升高，引起ADH血管升压素的分泌增多（B对A错），通过肾小管和集合管增加对水的重吸收，使尿量减少，不会导致肾小球过滤减少。肾素-血管紧张素系统活动增强，可引起醛固酮分泌增多（C错），醛固酮主要作用于肾远曲小管和集合管的上皮细胞，增加K⁺的排泄和增加Na⁺、水的重吸收，不是大量出汗时尿量减少的主要原因。交感神经兴奋，引起肾小球滤过减少（D错），常见于剧烈运动、大失血、缺氧和中毒性休克等情况。大量出汗时并不会出现血容量减少（E错）。